男，38岁。因胃癌行胃大部切除术，术前查Hb110g/L，术中失血约1100ml，已输入平衡盐溶液2000mL，术后第1天感胸闷气促。查体：T37.0℃，BP100/60mmHg。实验室检查：Hb80g/L。最好应给患者输
A. 悬浮红细胞
B. 浓缩血小板
C. 全血
D. 普通冰冻血浆
E. 新鲜冰冻血浆

正确答案：A。悬浮红细胞

解析：患者术中失血后补充大量平衡盐溶液，血压偏低但并无休克的症状及体征提示血容量已基本补足，Hb80g/L提示出现中度贫血（正常成年男性Hb浓度应不低于120g/L，60～90g/L为中度贫血），胸闷气促是由于贫血导致机体携氧能力下降，此时最好输注悬浮红细胞（A对）。悬浮红细胞是全血经离心去除大部分血浆后，加入红细胞保存液制备而成的，适用于大多数需要补充红细胞，提高携氧能力的患者。浓缩血小板（B错）主要作用是补充血小板，主要用于治疗再生障碍性贫血和各种血小板低下疾病。全血（C错）由于成分多样，易引发输血反应，现已很少应用。此外，若在贫血较严重但血容量正常时输注全血，易导致循环超负荷。普通冰冻血浆（D错）和新鲜冰冻血浆（E错）适合于多种凝血因子缺乏症、肝胆疾病引起的凝血障碍和大量输库存血的出血倾向。